下列各项，与慢性肾小球肾炎关系较密切的是
A. 火、寒、暑、湿
B. 风、寒、暑、湿
C. 燥、寒、暑、湿
D. 风、寒、火、湿、
E. 风、寒、湿、热

正确答案：E。风、寒、湿、热

解析：本病病位在肾，与肺脾相关，其病理基础在于脏腑的虚损。本病为本虚标实之证，正气亏虚为内因，因先天禀赋不足或劳倦太甚、饮食不节、情志不遂等，导致肺、脾、肾虚损，气血阴阳不足，又常因外感风、寒、湿、热（E对）之邪而发病。